男，70岁。患慢性阻塞性肺疾病12年。近1周来受凉后出现咳嗽、咳痰及呼吸困难加重。使用抗感染、平喘及糖皮质激素治疗效果欠佳。查体：半卧位，球结膜水肿，面色暗红，双肺呼吸音粗，心腹未见异常，双下肢轻度凹陷性水肿。该患者出现上述体征最可能的原因是
A. CO₂潴留
B. 糖皮质激素副作用
C. 右心衰竭
D. 药物过敏反应
E. 深静脉血栓形成合并肺栓塞

正确答案：A。CO₂潴留

解析：老年男性患者，COPD长期病史，近1周来受凉后出现咳嗽、咳痰及呼吸困难加重。查体：半卧位，球结膜水肿，面色暗红，双肺呼吸音粗，双下肢轻度凹陷性水肿。最可能的诊断是慢性肺源性心脏病。而该患者出现上述体征最可能的原因是高碳酸血症（A对）。